女，30岁，平素体健。甲状腺腺瘤切除术术后换药，伤口无红肿。手术切口拆线时间段应是术后
A. 6～7天
B. 2～3天
C. 10～12天
D. 7～9天
E. 4～5天

正确答案：E。4～5天

解析：颈部手术后，若病人情况良好，术后4-5日拆线（E对）。下腹部、会阴部在术后6-7天（A错）拆线；胸部、上腹部、背部、臀部在术后7-9天（D错）拆线；四肢在术后10-12天（C错）拆线。